一项胰腺癌的病例对照研究，病例组17%的患者被诊断为糖尿病，根据年龄、性别配对的对照组4%有糖尿病，由此推断糖尿病在胰腺癌发生中起了病因作用，该推论
A. 正确
B. 不对，因为没有可比人群
C. 不对，因为该研究不能提供糖尿病和胰腺癌发生之间明确的时间顺序
D. 不对，因为没有做假设检验
E. 不对，因为17%和4%不代表人群的发病率

正确答案：C。不对，因为该研究不能提供糖尿病和胰腺癌发生之间明确的时间顺序